以下哪种情况应视为心脏病患者拔牙的禁忌证
A. 稳定的心绞痛
B. 2年内发生过心肌梗死
C. 心功能Ⅱ级患者
D. 心功能Ⅲ级者
E. 血压175/95mmHg

正确答案：D。心功能Ⅲ级者

解析：心脏病：下列情况应视为拔牙的禁忌证：①6个月内发生过心肌梗死；②不稳定的或最近才开始的心绞痛；③充血性心力衰竭；④未控制的心律不齐；⑤未控制的高血压。如以心功能分级而言，心功能Ⅲ级者，应视为拔牙禁忌证，而对较重之心功能Ⅱ级患者，拔牙亦应慎重并有适宜的对策。掌握“牙拔除的适应证与禁忌证”知识点。